关于药物动力学参数表观分布容积（V）的说法，正确的是
A. 表观分布容积是体内药量与血药浓度间比例常数，单位通常是L或L/kg
B. 特定患者的表观分布容积是一个常数，与服用药物无关
C. 表观分布容积通常与体内血容量有关，血容量高，表观分布容积就越大
D. 特定药物的表观分布容积是一个常数，所以特定药物的常规临床剂量是固定的
E. 亲水性药物的表观分布容积往往超过体液的总体积

正确答案：A。表观分布容积是体内药量与血药浓度间比例常数，单位通常是L或L/kg

解析：本题考查表观分布容积V。表观分布容积是体内药量与血药浓度间的一个比例常数，用“V”表示，其单位通常是“体积”或“体积/千克体重”，如L、ml或L/kg（A对）；V与服用药物有关（B错），水溶性或极性大的药物通常表观分布容积较小，亲脂性药物通常表观分布容积较大；与体内血容量无关（C错）；V与药物在不同组织中的血流分布、药物的脂溶性、药物在不同类型组织的分配系数等有关，所以特定药物的常规临床剂量不是固定的（D错）；血液中水溶性或极性大的药物通常不易进入细胞内或脂肪组织中，血药浓度较高，表观分布容积较小，不会超过体液总体积（E错）。